固位体应具备的条件中，哪一项最不重要
A. 固位形和抗力形
B. 固位体形态及色泽美观
C. 各固位体间有共同就位道
D. 保护牙体组织及牙体活力
E. 正确恢复基牙形态和功能，材料强度好

正确答案：B。固位体形态及色泽美观

解析：固位体应具备条件：①固位形和抗力形：固位体应有良好的固位形和抗力形，能够抵御来自各方向的外力，而不至于松动、脱落和破损；②就位道：各固位体之间应能够取得固定桥所需的共同就位道；③材料性能：固位体所用材料要达到一定的机械强度，化学性能稳定，生物相容性良好；④保护牙体组织固位体应能够保护牙体组织，使基牙不因承受外力而断折；⑤保护牙体活力：固位体应能够保护活髓牙的牙髓组织，使牙髓不致因为物理和化学性刺激而产生病理性变化；⑥固位体边缘密合度：固位体边缘必须与基牙紧密贴合，不刺激软组织；⑦固位体外形：固位体应能够恢复基牙的解剖形态、生理功能、美观要求，并具有良好的自洁作用；功能上的要求是首要的，只有在保证功能情况下，才能考虑美观方面。掌握“固定桥的设计”知识点。